首选用于急性乳腺炎郁乳期的方剂是
A. 托里消毒散
B. 普济消毒饮
C. 瓜蒌牛蒡汤
D. 柴胡清肝汤
E. 五味消毒饮

正确答案：C。瓜蒌牛蒡汤

解析：急性乳腺炎可归属于中医学的乳痈，中医乳痈初期及郁乳期表现为肝胃郁热证，治宜疏肝清胃、通乳消肿，方选瓜蒌牛蒡汤加减治疗（C对）。托里消毒散（A错）适用于乳痈溃脓后正虚毒恋证。普济消毒饮（B错）为治疗大头瘟的代表方，适用于风热邪毒为患的丹毒、腮腺炎、扁桃体炎等。柴胡清肝汤（D错）疏肝清热，适用于血虚火动、肝气郁结之证。五味消毒饮（E错）清热解毒，消散疔疮，用于治疗疔疮初起。